意识清楚，兴趣减退，思维迟缓言语动作减少
A. 情感淡漠
B. 抑郁状态
C. 痴呆状态
D. 脑衰弱综合征
E. 缄默状态

正确答案：B。抑郁状态

解析：意识清楚、兴趣减退、思维迟缓言语动作减少是抑郁状态的表现（B对）。情感淡漠表现为面部表情呆板，对周围发生的事物漠不关心，即使对与自身有密切利害关系的事情也如此（A错）。痴呆以智能减退为主要表现（C错）。